肺心病出现精神障碍主要见于
A. 肺泡毛细血管急性损伤
B. 支气管肺感染和阻塞
C. 肺弥散功能障碍
D. 肺动脉高压
E. 肺性脑病

正确答案：E。肺性脑病

解析：肺心病时，体内出现低氧血症和高碳酸血症，CO₂潴留使脑脊液H⁺浓度增加，影响脑细胞代谢，降低脑细胞兴奋性，抑制皮质活动，可表现为白天嗜睡，甚至出现表情淡漠、神志恍惚、谵妄等，这种神经精神障碍称为肺性脑病（E对）。肺泡毛细血管急性损伤（A错）是急性呼吸窘迫综合征的病理表现。支气管肺感染和阻塞（B错）是支气管扩张的发病机制。肺弥散功能障碍（C错）是导致肺换气功能障碍的原因之一。肺动脉高压（D错）是导致肺源性心脏病的主要机制。